实验流行病学研究中，影响样本量大小的因素描述正确的是
A. 实验组和对照组的差异越大，需要的样本量越大
B. 单侧检验比双侧检验所需样本量小
C. 如果肯定实验组的效果好于对照组，应该选择双侧检验
D. 研究对象分组数量越多，所需要的样本量越少
E. 所研究疾病的治愈率越低，所需要的样本量越少

正确答案：B。单侧检验比双侧检验所需样本量小

解析：本题考查实验流行病学研究中，影响样本量大小的因素。影响样本量大小的主要因素有：1.实验组和对照组结局事件指标的数值差异大小：差异越小，所需的样本量越大；2.显著性水平：即检验假设时的第Ⅰ类错误α值；3.把握度，即1－β，为拒绝无效假设的能力或避免假阴性的能力；4.单侧检验或双侧检验：单侧检验比双侧检验所需样本量小（B对ACDE错）；5.研究对象分组数量：分组数量越多，则所需样本量越大。